男，45岁。车祸致左枕部着地，当即意识丧失，送至附近医院途中右侧肢体间断性抽搐伴喷射性呕吐3次。查体：P56次/分，BP160/95mmHg，浅昏迷、躁动，右侧瞳孔直径约4mm，左侧2mm；对光反射：左侧存在，右侧消失，左侧肌力3级，右侧肌力5级；左枕部头皮水肿，颈强直。最主要的诊断是
A. 右额急性硬脑膜下血肿伴左小脑幕切迹疝
B. 右额急性硬脑膜下血肿伴右小脑幕切迹疝
C. 左额广泛脑挫裂伤伴左小脑幕切迹疝
D. 左额急性硬脑膜下血肿伴左小脑幕切迹疝
E. 左额急性硬脑膜下血肿伴右小脑幕切迹疝

正确答案：B。右额急性硬脑膜下血肿伴右小脑幕切迹疝

解析：中年男性患者，车祸致左枕部着地，当即意识丧失，送至附近医院途中右侧肢体间断性抽搐伴喷射性呕吐3次（颅内压增高）。查体：P56次/分（正常值60～100次/分），BP160/95mmHg（正常值90～120/60～80mmHg），浅昏迷、躁动，右侧瞳孔直径约4mm（正常值2～4mm），左侧2mm；对光反射：左侧存在，右侧消失，左侧肌力3级，右侧肌力5级；左枕部头皮水肿，颈强直。患者右侧对光反射消失，可诊断为右小脑幕切迹疝。患者左侧肌力3级，右侧肌力5级可诊断为右侧额部急性硬脑膜下血肿（B对）。